女性，32岁，进行性膀胱刺激症状，经抗生素治疗不见好转，且伴有右侧腰部胀痛及午后潮热。尿液检查对诊断有决定性意义的是
A. 血尿
B. 脓尿
C. 尿普通细菌培养
D. 尿沉渣找结核杆菌
E. 尿细胞学检查

正确答案：D。尿沉渣找结核杆菌

解析：青年女性患者，进行性膀胱刺激症状（提示可能有泌尿系感染），经抗生素治疗不见好转（提示为特异性感染），伴有右侧腰部胀痛及午后潮热（结核中毒典型表现），结合患者病史和临床表现，该患者最可能的诊断为肾结核，为明确诊断，最有价值的检查是尿沉渣找结核杆菌（D对）。血尿（A错）主要见于泌尿系损伤、急性肾小球肾炎，也可见于肾结核患者，故对该病诊断价值不大。脓尿（B错）主要见于金葡菌等感染所致的泌尿系化脓性感染。尿普通细菌培养（C错）对肾结核的诊断没有意义，因为结核杆菌感染属于特异性感染，结核杆菌不包括在普通细菌内。尿细胞学检查（E错）主要用于泌尿系肿瘤的筛查。